治疗痞满肝胃不和证，应首选
A. 枳实导滞丸
B. 保和丸
C. 越鞠丸合枳术丸
D. 二陈平胃散
E. 香砂六君子汤

正确答案：C。越鞠丸合枳术丸

解析：枳实导滞丸为痞满饮食停滞证伴食积化热，大便秘结者的选方，功能推荡积滞，清利湿热（A错）。保和丸为痞满饮食内停证的选方，功能消食导滞，行气消痞（B错）。痞满肝胃不和证为肝气犯胃，胃气郁滞所致，治疗应疏肝解郁，和胃消痞，方选越鞠丸合枳术丸（C对）。二陈平胃散为痞满痰湿中阻证的选方，功能燥湿健脾，化痰利气（D错）。香砂六君子汤为痞满脾胃虚弱证伴舌苔厚腻，湿浊内蕴者的选方，功能健脾祛湿，理气除胀（E错）。